甲亢患者对碘剂过敏，心率快，术前用药应该选择以下哪一项
A. 普萘洛尔
B. 胺碘酮
C. 强心苷
D. 利多卡因
E. 比索洛尔

正确答案：A。普萘洛尔

解析：患者对碘剂过敏，心率快，术前用药应该选择普萘洛尔（A对）。甲亢患者术前药物准备有：（1）抗甲状腺药物加碘剂：此法安全可靠，但准备时间较长。（2）单用碘剂：适合症状不重，以及继发性甲亢和高功能腺瘤病人。（3）普洛萘尔：对于常规应用碘剂或合并应用硫氧嘧啶类药物不能耐受或无效者，有主张单用普洛萘尔或与碘剂合用作术前准备。